半夏粉末的显微特征中有
A. 草酸钙柱晶
B. 草酸钙簇晶
C. 草酸钙针晶束
D. 草酸钙方晶
E. 草酸钙砂晶

正确答案：C。草酸钙针晶束